具有清热利湿功效的药物是
A. 丹参
B. 牛膝
C. 苏木
D. 姜黄
E. 虎杖

正确答案：E。虎杖

解析：虎杖微苦、微寒。归肝、胆、肺经。具有利湿退黄，清热解毒，散瘀止痛，化痰止咳的功效。（E对）